确定接触者的留验、检疫和医学观察时限，取决于疾病的
A. 传染期
B. 恢复期
C. 临床症状期
D. 潜伏期
E. 发病期

正确答案：D。潜伏期

解析：本题考查疾病潜伏期的意义。潜伏期（D对ABCE错）的流行病学意义为：①根据潜伏期的长短判断病人受感染的时间；②根据潜伏期的长短确定接触者的留验、检疫和医学观察期限；③根据潜伏期的长短确定免疫接种的时间；④根据潜伏期来评价防制措施的效果；⑤潜伏期的长短会影响疾病的流行特征。